苯妥英钠的消除速率与血药浓度有关。在低浓度（低于10㎍/ml）时，消除过程属于一级过程；高浓度时由于肝微粒体代谢酶能力有限，则按零级动力学消除，此时只要稍微增加剂量就可使血药浓度显著升高，易出现中毒症状。苯妥英钠在临床上的有效血药浓度范围是10～20㎍/ml。关于苯妥英钠在较大浓度范围的消除速率的说法，正确的是
A. 用米氏方程表示，消除快慢只与参数Vm有关
B. 用米氏方程表示，消除快慢与参数Km和Vm有关
C. 用米氏方程表示，消除快慢只与参数Km有关
D. 用零级动力学方程表示，消除快慢体现在消除速率常数k₀上
E. 用一级动力学方程表示，消除快慢体现在消除速率常数k上

正确答案：B。用米氏方程表示，消除快慢与参数Km和Vm有关

解析：本题考查米氏方程。苯妥英钠在较大浓度范围的消除速率用米氏方程表示，消除快慢与参数Km和Vm有关（B对）；Michaelis-Menten方程是基于药物在载体或酶的参与下进行体内转运或消除过程，因为需要特定的酶或载体参与，而酶或载体的量有一定的限度，当反应物量增加到一定程度时，其反应速度并不能随着反应物的量增加而加快，即具有一定限度，因此这些过程为具有饱和过程的动力学，即具有非线性动力学特征，用米氏方程表示（DE错），其方程式为-dC/dt=Vm·C/（Km+C），消除快慢与参数Km和Vm有关（AC错）。